可引起体位性低血压的抗高血压药有
A. 哌唑嗪
B. 乌拉地尔
C. 利血平
D. 氯沙坦
E. 硝普钠

正确答案：A、B、C、E。哌唑嗪；乌拉地尔；利血平；硝普钠

解析：本题考查抗高血压药的不良反应。常见的能够引起体位性低血压的药物，主要为α受体阻断剂，其常见的药物有酚妥拉明、哌唑嗪（A对）、特拉唑嗪、乌拉地尔（B对）等。除此之外，还有一些硝酸酯类的药物，也容易引起体位性低血压，比如硝酸甘油、硝普钠（E对）和利血平（C对）等等，这些药物可以扩张人体的血管，并且使得血管的神经反射的调节功能出现失衡，最终引起体位性低血压。氯沙坦（D错）为血管紧张素Ⅱ受体拮抗药，常见不良反应有胃肠道反应、过敏反应等。